药物代谢主要在
A. 肝脏
B. 肾脏
C. 肺
D. 脑
E. 心

正确答案：A。肝脏

解析：生物转化是指机体在排出一些非营养物质前对其进行代谢，使其水溶性提高，极性增强，易于通过胆汁或尿排出，药物代谢亦属于生物转化。肝是机体内生物转化最重要的器官，因此药物代谢主要在肝脏（A对）。皮肤、肺（C错）及肾（B错）等亦有一定的生物转化作用。脑（D错）和心（E错）没有生物转化的功能。